患者，女，60岁，主诉全口牙齿松动半年余，近两月松动加重，影响进食。如X线显示牙槽骨吸收Ⅲ度，则X线可能见到临床表现为
A. 牙槽骨吸收在牙根的颈1/3以内
B. 牙根吸收在牙根的颈1/3以内
C. 牙槽骨吸收超过根长1/3，但在根长2/3以内
D. 牙槽骨吸收占根长2/3以上
E. 牙根吸收占根长2/3以上

正确答案：D。牙槽骨吸收占根长2/3以上

解析：骨吸收的程度一般按吸收区占牙根长度的比例来描述，通常分为三度。Ⅰ度：牙槽骨吸收在牙根的颈1/3以内；Ⅱ度：牙槽骨吸收超过根长1/3，但在根长2/3以内，或吸收达根长的1/2；Ⅲ度：牙槽骨吸收占根长2/3以上。掌握“慢性牙周炎的病因，表现诊断及预后”知识点。